有关左心室的描述，错误的是
A. 入口有二尖瓣
B. 二尖瓣游离缘连有腱索
C. 出口有肺动脉瓣
D. 左心室内可分流入道和流出道
E. 左心室壁比右心室厚

正确答案：C。出口有肺动脉瓣

解析：左心室入口有二尖瓣（A对）。二尖瓣游离缘连有腱索（B对）。出口有主动脉瓣（C错，为本题正确答案）。左心室内以二尖瓣前尖为界可分流入道和流出道（D对）。左心室壁厚约是右室壁厚的三倍（E对）。